常作为苯胺中毒时的解毒剂的是
A. 依地酸钙钠
B. 阿托品
C. 亚甲蓝
D. 二巯基丙磺酸钠
E. 亚硝酸钠-硫代硫酸钠

正确答案：C。亚甲蓝